Kappa值为0.40以下时可定为
A. 完全不可靠
B. 可靠度不合格
C. 可靠度中等
D. 可靠度优
E. 完全可靠

正确答案：B。可靠度不合格

解析：本题考查标准一致性试验。Kappa值为0.40以下时可定为可靠度不合格（B对）。Fleiss规定Kappa值的大小与可靠度的关系为：1.0.4以下，可靠度不合格；2.0.41～0.060，可靠度中等（C错）；3.0.61～0.80，可靠度优（D错）；4.0.81～1.00，完全可靠（E错）。没有完全不可靠（A错）这个标准。